男性，62岁，急性重症胰腺炎患者，于保守治疗中，尿量逐渐减少，无尿2日，出现气促、全身水肿，血压180/92mmHg，心率120次/分，听诊闻及两下肺布满细湿啰音，查血钾6.9mmol/L，BUN25.2mmol/L，肌酐577mol/L，目前应采取的最有效治疗手段是
A. 袢利尿剂静脉注射
B. 静滴甘露醇利尿
C. 口服甘露醇或硫酸镁导泻
D. 控制入液量，停止补钾
E. 及时紧急透析

正确答案：E。及时紧急透析

解析：老年男性，急性重症胰腺炎患者，治疗中尿量逐渐减少、无尿2日、全身水肿（肾功能不全的表现），血压180/92mmHg（正常值为90～130/60～90mmHg，提示有高血压）。查血钾6.9mmol/L（正常3.5～5.5mmol/L，提示血钾升高），BUN25.2mmol/L（血尿素氮正常值为3.2～7.1mmol/L，提示有氮质血症），肌酐577mol/L（正常值为88.4～176.8mmol/L，提示肌酐升高），考虑急性重症胰腺炎并发急性肾衰竭。患者血钾＞6.5mmol/L，可导致心脏骤停，需紧急处理，最有效的治疗手段为及时紧急透析（E对），可迅速清除体内的高钾及尿素氮、肌酐、过多的水分等，改善病情，延缓病变进展。控制入液量，停止补钾（D错）为高钾血症的基本治疗措施。袢利尿剂静脉注射（A错）可以通过尿液增加钾的排出；口服甘露醇或硫酸镁导泻（C错）可以通过胃肠道途径增加钾的排出，均起效较慢，不是目前最有效的治疗手段。静滴甘露醇利尿（B错）主要用于降低颅内压。